患者，男，65岁。有前列腺增生病史，小便频数不爽，淋沥不尽，伴头晕目眩，腰膝酸软，尿黄而热，舌红少苔，脉细数，治疗应首选
A. 抵当丸
B. 肾气丸
C. 知柏地黄汤
D. 前列腺汤
E. 八正散

正确答案：C。知柏地黄汤

解析：患者，男，65岁有前列腺增生病史，湿热蕴结膀胱，气化不利，下迫尿道，故见小便频数不爽，淋沥不尽；肾阴不足，头目、腰膝失养故见头晕目眩，腰膝酸软；肾阴不足故见尿黄而热，舌红少苔，脉细数（C对）。伤寒有热，小腹满，小便不利，治法：破血逐瘀，方药：抵当丸（A错）。肾阳不足证，治法：温补肾阳，通窍利尿，方药：肾气丸加减（B错）。痰瘀阻络证，治法：活血化瘀，行气导滞，方药：前列腺汤（D错）。湿热下注证，治法：清热利湿，消癃通闭，方药：八正散加减（E错）。